在传染科工作，以下做法是适当的
A. 为了增强患者的信心，医生检查治疗时，尽可能少地采取隔离措施
B. 为了避免被传染，医生尽可能少地接触患者
C. 将日常护理交给患者家属承担
D. 严格按照操作规程进行检查和治疗
E. 家属询问才解释有关的预防知识，否则不主动提起

正确答案：D。严格按照操作规程进行检查和治疗

解析：传染病具有传染性，能迅速在人群中散播，影响公众健康，社会危害性大，自古至今都是危害人类健康的主要杀手。随着免疫技术、抗生素、公共卫生等医学知识和技术的进步，目前人类在与传染病的斗争中取得了辉煌的成就，也总结出了传染病防控的伦理要求。1.严格执行隔离消毒措施和各项操作规程，隔离、消毒是传染病管理与防治工作中最重要的环节，也是公共卫生工作者与传染病斗争的重要内容（D对）。2.坚持预防为主的积极防疫思想，与一般疾病相比，传染病患者的治疗十分重要，同等重要的还有易感人群保护，控制其流行范围，避免社会灾难。3.尊重传染病患者的人格和权利，在世俗观念中，传染病患者，特别是性病、艾滋病患者，往往受到不应有的歧视、排挤，有时甚至发生惨剧。4.遵守国家法律规定，及时收集与上报疫情，现代社会已经建立了相对完善的传染病防治体系，及时发现、隔离、治疗各种传染病患者（ABCE错）